通常，生物氧化是指生物体内
A. 脱氢反应
B. 营养物氧化成H₂O和CO₂的过程
C. 加氧反应
D. 与氧分子结合的反应
E. 释出电子的反应

正确答案：B。营养物氧化成H₂O和CO₂的过程